体温调节中枢主要位于
A. 脊髓
B. 廷髓
C. 丘脑下部
D. 小脑
E. 大脑皮质

正确答案：C。丘脑下部